关于抗心力衰竭药物沙库巴曲缬沙坦的说法，错误的是
A. 通过抑制脑啡肽酶，同时阻断血管紧张素Ⅱ的1型受体（AT₁）起效
B. 与血管紧张素转换酶抑制剂（ACEI）合用具有协同作用
C. 适用于射血分数降低的慢性心力衰竭（NYHAⅡ-Ⅳ级，LVEF≤40%）成年患者
D. 血钾水平>5.4mmol/L的患者不可使用
E. 重度功能损害（Child-PughC级）患者不推荐使用

正确答案：B。与血管紧张素转换酶抑制剂（ACEI）合用具有协同作用

解析：本题考查沙库巴曲缬沙坦。沙库巴曲缬沙坦与血管紧张素转换酶抑制剂（ACEI）合用时存在血管性水肿的潜在风险，禁止与ACEI合用（B错，为本题正确答案）。沙库巴曲缬沙坦通过抑制脑啡肽酶，同时阻断血管紧张素Ⅱ的1型受体（AT₁）起效（A对）。用于射血分数降低的慢性心力衰竭（NYHAⅡ-Ⅳ级，LVEF≤40%）成年患者（C对），降低心血管死亡和心力衰竭住院的风险。血钾水平>5.4mmol/L的患者不可使用（D对）。重度功能损害（Child-PughC级）患者不推荐使用（E对）。